感染性休克的临床表现不包括
A. 起病迅猛
B. 循环功能不全
C. 皮肤潮红
D. 精神萎靡、嗜睡
E. 双眼凝视无神

正确答案：C。皮肤潮红

解析：感染性休克主要继发于以释放内毒素的革兰阴性杆菌为主的感染，如急性腹膜炎、胆道感染、绞窄性肠梗阻及泌尿系感染等。临床表现为起病迅猛（A对）、循环功能不全（B对）、精神萎靡、嗜睡（D对）、双眼凝视无神（E对）、皮肤多苍白、发绀而非潮红（C错，为本题正确答案）。